关于心脏病患者，可考虑拔牙的为
A. 失血性心力衰竭
B. 不稳定心绞痛
C. 未控制的高血压或心律不齐
D. 一个月前发生过心肌梗死
E. 右束支传导阻滞、心功能Ⅰ级

正确答案：E。右束支传导阻滞、心功能Ⅰ级

解析：本题考查心脏病患者的拔牙禁忌证。关于心脏病患者，可考虑拔牙的为右束支传导阻滞、心功能Ⅰ级（E对）。对于大多数患者系统疾病的患者来说，拔牙禁忌症具有相对性。一般而言，心脏病患者如心功能尚好，为Ⅰ或Ⅱ级，可以耐受拔牙术及其他口腔小手术。失血性心力衰竭患者拔牙，功能代偿不全，可造成严重不良后果，一般不考虑拔牙（A错）。不稳定心绞痛的患者拔牙威胁生命安全，实行口腔手术有危险（B错）。未控制的高血压或心律不齐的心脏病患者多有左心室心肌肥厚、扩张，器官病变严重，实行口腔手术有生命危险（C错）。一个月前发生过心肌梗死患者拔牙时，疼痛、恐惧、紧张等再次可诱发使再次发生心梗，极为危险（D错）。